流感病毒抗原变异的种类包括
A. 基因突变和抗原漂移
B. 抗原漂移和抗原转换
C. 基因突变和抗原转换
D. 表面抗原变异和抗原漂移
E. 核蛋白抗原变异和抗原转换

正确答案：B。抗原漂移和抗原转换